有关骨的构造，正确的说法是
A. 骨干由骨松质构成
B. 骨骺由骨密质构成
C. 骨膜有血管无神经
D. 骨髓有神经无血管
E. 以上全不对

正确答案：E。以上全不对

解析：骨干既有骨密质也有骨松质（A错）。骨骺，外周是薄层的骨密质，内部为大量的骨松质（B错）。骨膜主要由纤维结缔组织构成，被覆于关节面以外的骨表面，含有丰富的神经、血管和淋巴管（C错）。骨髓也有神经也有血管（E对D错）。